成分输血的优点不包括
A. 纯度高
B. 疗效好
C. 容易制备
D. 便于保存
E. 保护血液资源

正确答案：C。容易制备

解析：成分输血针对不同的血液病人有侧重的输入不同的成分，疗效好（B对），治疗确切。制备的不同的血液成分有着纯度高（A对）、浓度高等优点，更有利于疾病的治疗。血液成分相较于全血更加便于保存（D对）。成分输血也能节约血资源，保护血液资源（E对）。血液成分的提取和加工处理是一个相对复杂的过程，故容易制备不是成分输血的优点（C错，为本题正确答案）。